主要目标细菌耐药率超过75%的抗菌药物，应当
A. 慎重经验用药
B. 继续大剂量用药
C. 参照药敏试验结果选用
D. 及时将预警信息通报本机构医务人员
E. 暂停针对此目标细菌的临床应用，追踪、再决定是否恢复应用

正确答案：E。暂停针对此目标细菌的临床应用，追踪、再决定是否恢复应用

解析：主要目标细菌耐药率超过75%的抗菌药物，应当暂停针对此目标细菌的临床应用，根据追踪细菌耐药监测结果，再决定是否恢复临床应用。掌握“抗菌药物临床应用概述及管理”知识点。